IUD取出通常选择的时间在
A. 月经来潮后6小时内
B. 月经期2—3日
C. 月经期5—6日
D. 月经干净3—7日
E. 月经干净10-14日

正确答案：D。月经干净3—7日

解析：IUD取器时间①月经干净后3-7日为宜（D对E错）②带器早期妊娠行人工流产同时取器③带器异位妊娠术前行诊断性刮宫时或在术后出院前取出IUD④子宫不规则出血者随时可取，取IUD同时需诊断性刮宫，刮出组织送病理检查，排除子宫内膜病变。判断有无排卵或黄体功能不良，在月经前或月经来潮6小时内刮宫。